属于《国际性研究中的伦理与政策问题：发展中国家的临床试验》2001的内容的是
A. 科技必须考虑公共利益
B. 应该保护个人家庭与社群防止歧视和侮辱
C. 提供已确定的有效治疗作为对照
D. 区分医疗与研究之间的界限
E. 研究人员机构与商业实体有权获得公平回报

正确答案：C。提供已确定的有效治疗作为对照

解析：《国际性研究中的伦理与政策问题：发展中国家的临床试验》2001的内容的是：①对临床实验伦理行动的基本要求②提供已确定的有效治疗作为对照（C对）。③公平对待和尊重参加者。④获得试验后利益。⑤在国际性临床试验中确保保护参加者。并于2003年修订推出《人类辅助生殖技术规范》《人类精子库基本标准和技术规范》《人类辅助生殖技术和人类精子库伦理原则》提出科技必须考虑公共利益（A错）。《国际人类基因组组织伦理委员会关于人类基因组数据库的声明（2002年）》建议提出应该保护个人家庭与社群防止歧视和侮辱（B错）。《贝尔蒙报告》认为区分生物医学和行为学研究与常规认可的行医是很重要的，提出了行医与科研的分界（D错）。《国际人类基因组组织伦理委员会关于人类基因组数据库的声明（2002年）》建议提出研究人员机构与商业实体有权获得公平回报（E错）。